普萘洛尔的禁忌证是
A. 甲状腺机能亢进
B. 心绞痛
C. 高血压
D. 心律失常
E. 支气管哮喘

正确答案：E。支气管哮喘

解析：本题考查普萘洛尔的禁忌证。普萘洛尔的禁忌证是支气管哮喘（E对）。普萘洛尔禁忌证：①支气管哮喘。②心源性休克。③心脏传导阻滞（二至三度房室传导阻滞）。④重度或急性心力衰竭。⑤窦性心动过缓。甲状腺机能亢进（A错）、心绞痛（B错）、高血压（C错）及心律失常（D错）均为普萘洛尔的适应证。